麻醉药品连续使用产生身体依赖性的特征包括
A. 强迫性地要求连续用药，并且不择手段地去获取药品
B. 有加大剂量和增加使用次数的趋势
C. 麻醉药品在停止使用后，有戒断症状出现
D. 对用药者本人及社会产生危害
E. 集中表现在持“麻醉药品专用卡”的癌症病人身上

正确答案：A、B、C、D。强迫性地要求连续用药，并且不择手段地去获取药品；有加大剂量和增加使用次数的趋势；麻醉药品在停止使用后，有戒断症状出现；对用药者本人及社会产生危害